据《灵枢·天年》，下列哪项不是长寿的特征
A. 五脏坚固，血脉和调
B. 肌肉解利，皮肤致密
C. 营卫之行，不失其常
D. 数中风寒喘息暴疾
E. 呼吸微徐，气以度行

正确答案：D。数中风寒喘息暴疾

解析：五脏强健而功能正常，血脉调和匀畅，肌肉间隙通利，皮肤致密，营气和卫气的运行正常，呼吸细微、和缓，体内之气按一定规律运行，六腑正常运化水谷饮食物，并将所化生的津液布散全身，身体各部的功能活动都正常进行，就能够长寿（ABCE对）。数中风寒喘息暴疾不是长寿的特征（D错，为本题正确答案）。